下列成瘾性极小的镇痛药是
A. 哌替啶
B. 可待因
C. 美沙酮
D. 喷他佐辛
E. 芬太尼

正确答案：D。喷他佐辛

解析：喷他佐辛（D对）主要激动K阿片受体发挥镇痛作用，对μ型阿片受体有弱的拮抗作用，无明显欣快感和成瘾性，但不能拮抗吗啡的呼吸抑制作用，并能促进吗啡成瘾者出现戒断症状，临床主要用于轻、中度疼痛的短期止痛。哌替啶（A错）为人工合成的μ受体激动剂，为目前临床上应用最广泛的人工合成镇痛药，长期反复应用也易引起耐受性和成瘾性。可待因（B错）药理作用与吗啡相似，本身对阿片受体亲和力低，镇痛作用仅为吗啡1/10，镇静作用不明显，欣快感和成瘾性弱于吗啡。美沙酮（C错）为μ型阿片受体激动剂，镇痛作用与吗啡相当，镇静、抑制呼吸等作用弱于吗啡，耐受性和成瘾性发生较慢，戒断症状略轻。芬太尼（E错）的化学结构与哌替啶相似，主要激动μ型阿片受体，效价强度为吗啡的80倍，可产生明显欣快、呼吸抑制和成瘾性，临床用于各种剧痛。